治疗久泻不止，不宜过用
A. 健脾
B. 补肾
C. 升提
D. 固涩
E. 分利

正确答案：E。分利

解析：泄泻总的病机是脾虚湿盛，长期泄泻，脾病及肾，肾阳亏虚，故应补肾；基本病机脾虚还在，故应健脾；久泻，脾虚长期不治疗亦可见脱肛等中气下陷的临床证候，治疗应升提；久泻出现滑脱不禁等症状时，据急则治标的原则，宜固涩止泻（ABCD错）。久泻多为脾虚失运或脏腑生克所致，水湿为长期不运而积，总属虚中夹实，若通过分利小便来治疗则会伤正，越虚则湿越积，泄泻越重。（E对）